平喘药物包括
A. 二丙酸倍氯米松
B. 沙丁胺醇
C. 异丙肾上腺素
D. 色甘酸钠
E. 氨茶碱

正确答案：A、B、C、D、E。二丙酸倍氯米松；沙丁胺醇；异丙肾上腺素；色甘酸钠；氨茶碱

解析：本题考查平喘药。平喘药按作用机制分可为六类：①β₂受体激动剂：沙丁胺醇（B对）、特布他林、沙美特罗、异丙肾上腺素（C对）等。②M胆碱受体阻断剂：异丙托溴铵。③黄嘌呤类药物：茶碱、氨茶碱（E对）、多索茶碱、二羟丙茶碱等。④过敏介质阻释剂：肥大细胞膜稳定剂色甘酸钠（D对），H₁受体阻断剂酮替芬等。⑤肾上腺皮质激素：氢化可的松、布地奈德、氟替卡松、二丙酸倍氯米松（A对）等。⑥白三烯调节剂：孟鲁司特、扎鲁司特、普仑司特等。